患者，女，39岁。诊断为急性胰腺炎，症见全腹疼痛，痛而拒按，发热，口苦而干，脘腹胀满，小便短赤，大便秘结，舌红，苔黄腻，脉滑数。其证型是
A. 肝郁气滞
B. 肠胃热结
C. 肝胆湿热
D. 肝郁脾虚
E. 血瘀内停

正确答案：B。肠胃热结

解析：中青年女性患者，诊断为急性胰腺炎，属中医“胰瘅”范畴，症见全腹疼痛，痛而拒按，发热，口苦而干，脘腹胀满，小便短赤，大便秘结，舌红，苔黄腻，脉滑数，此为肠胃热结之证（B对）。胰瘅之肝郁气滞证症见：突发中上腹痛，痛引两胁，或向右肩背部放射，恶心呕吐，口干苦，大便不畅，舌淡红，苔薄白，脉弦细或沉紧（A错）。胰瘅之肝胆湿热证症见：上腹胀痛拒按，胁痛，或有发热，恶心呕吐，目黄身黄，小便短黄，大便不畅，舌红，苔薄黄或黄腻，脉弦数（C错）。胰瘅之肝郁脾虚证症见：上腹及两胁胀痛，或时发剧痛，牵及胸背，倦怠乏力，嗳气，饮食减少，腹胀便溏，舌暗淡，苔薄白，脉弦细弱（D错）。胰瘅之血瘀内停证症见：上脘腹刺痛，痛处固定，入夜尤甚，面色晦暗，腹部或有癥块，拒按，形体消瘦，纳呆，恶心呕吐，或大便溏薄，舌紫暗或有瘀点，脉弦涩（E错）。